下列关于下颌磨牙髓腔形态的叙述中，正确的是
A. 近远中径＞颊舌径＞髓室高度
B. 髓室底多见3～4个根管口
C. 下颌磨牙的髓室呈矮立方形
D. 下颌第三磨牙髓腔变异很大
E. 以上均正确

正确答案：E。以上均正确

解析：本题考查下颌磨牙髓腔的形态特点。下颌第一磨牙与第二磨牙髓腔形态相似，髓室均呈矮立方形（C对），近远中径＞颊舌径＞髓室高度（A对），多为3～4个根管（B对），而第三磨牙外形变异较多，髓腔形态随外形而异，变化较大（D对）。综上所述，以上均正确(E对，为本题正确答案)。